心功能不全发展过程中无代偿意义的变化是
A. 心率加快
B. 心肌收缩力增强
C. 心肌肥大
D. 心脏肌源性扩张
E. 全身血流重分布

正确答案：D。心脏肌源性扩张

解析：心功能不全时，心脏本身会发生功能和结构的代偿，同时机体启动心外的多种代偿机制，以适应心排血量降低。心脏本身代偿包括心率增快（A错）、心脏紧张源性扩张、心肌收缩性增强（B错）、心室重塑。心脏肌源性扩张（D对）是指当前负荷过大使肌节长度被拉伸超过2.2μm时，心脏从紧张源性扩张转为肌源性扩张，有效横桥的数目减少，心肌收缩力降低，对心功能不全无代偿意义。心肌肥大（C错）属于心室重塑的一种，是慢性心功能不全极为重要的代偿方式。心外代偿包括血容量增加、全身血流重分布（E错）等。